一项雌激素与子宫内膜癌关系的配对病例对照研究，共包括63对研究对象，病例与对照均有雌激素暴露史者共27对，两者均无暴露史者4对，病例有暴露史而对照无暴露史者29对，其余为对照有暴露而病例无暴露者。则OR为
A. 10.67
B. 9.67
C. 4.47
D. 2.24
E. 1.24

正确答案：B。9.67

解析：本题考查匹配病例对照研究的资料分析。详见“表5-4 外源性雌激素与子宫内膜癌关系的配对病例对照研究资料”。根据公式计算OR＝c/b（b≠0）＝29/3＝9.67（B对ACDE错）。